进行一次膳食与高血压关系的病例对照研究，最常见的信息偏倚是
A. 入院率偏倚
B. 奈曼偏倚
C. 检出症候偏倚
D. 无应答偏倚
E. 回忆偏倚

正确答案：E。回忆偏倚